服用脂溶性维生素时宜
A. 适当多食脂肪
B. 少食盐
C. 少食醋
D. 不吸烟
E. 不饮酒

正确答案：A。适当多食脂肪

解析：本题考查饮食对药物疗效的影响。服用脂溶性维生素时，可适当多食脂肪（A对），以促进药物的吸收，增进疗效。食盐（B错）可影响血液的容量和渗透压。食醋（C错）的成分为醋酸，与碱性药及中性药同服，可发生酸碱中和反应，使药物失效。吸烟（D错）能影响很多药物的吸收、作用和药效。饮酒（E错）对脂溶性维生素的吸收几乎无影响。